足月儿皮肤外观的特点是
A. 皮肤发亮
B. 皮肤水肿
C. 皮肤毳毛多
D. 皮下脂肪少
E. 肤色红润

正确答案：E。肤色红润

解析：足月儿皮肤红润（E对）、皮下脂肪丰满（D错）、毳毛少（C错）。早产儿皮肤绛红、水肿（B错）发亮（A错）、毳毛多。